既凉血止血，又清泻肝火的药是
A. 槐花
B. 大蓟
C. 地榆
D. 白茅根
E. 侧柏叶

正确答案：A。槐花

解析：本题考查的是槐花的功效。既凉血止血，又清泻肝火的药是槐花（A对）。槐花：【功效】凉血止血，清肝泻火。大蓟（B错）：【功效】凉血止血，散瘀消痈。地榆（C错）：【功效】凉血止血，解毒敛疮。白茅根（D错）：【功效】凉血止血，清热生津，利尿通淋。侧柏叶（E错）：【功效】凉血止血，祛痰止咳，生发乌发。